中药养护中吸湿防潮法可采用的干燥剂是
A. 干冰
B. 生石灰
C. 熟石灰
D. 氯化钠
E. 氢氧化钙

正确答案：B。生石灰

解析：本题考查的是吸湿防潮法常采用的干燥剂。中药养护中吸湿防潮法可采用的干燥剂是生石灰（B对）。吸湿防潮法：为了保持库房贮存药物环境的干燥，除采取上述通风法来降低湿度外，也可用除湿机保持环境的干燥，或采用干燥剂来吸收空气或药物中的水分。吸潮方法通常采用以下三种。①选择条件较好的小库房全部密封后，放入干燥剂，以减少库内湿度，保持贮存环境的干燥。②选择一定的容器（如缸、罐、皮箱、铁桶、糊封后的木箱等），放入适量的生石灰，用薄木板隔开，上放置药物，以吸收药物的水分，保持其经常干燥。常采用的干燥剂有：生石灰块，又名氧化钙，具有取材和使用方便、成本低、吸湿率高等特点，其吸潮率可达20%～25%，是传统养护方法中一种主要的吸潮剂。无水氯化钙，是一种白色无定形的固体，呈粒状、块状或粉状。吸潮率可达到100%～120%。氯化钙吸潮后即溶化成液体，将其溶化物放在搪瓷盆内加热，待水分蒸发，仍能恢复固体块状，可重复使用。③可利用日晒或采用加热烘干，使饮片的水分散失，保持干燥。